防治疾病的基本原则是
A. 寒者热之
B. 调整阴阳
C. 热者寒之
D. 补其不足
E. 损其有余

正确答案：B。调整阴阳

解析：天地万物变化之根本源于自身的内在动力，如《易传·系辞上》：“刚柔相推而生变化”。刚柔，是指性质相反的两个方面、两种力量，总括为阴阳，阴阳的相互对立、相互作用推动着事物的变化和发展。中医学关于人类生命活动过程及其运动变化规律的认识，受到《周易》的深刻影响。《素问·阴阳应象大论》说：“阴阳者，天地之道也，万物之纲纪，变化之父母，生杀之本始，神明之府也，治病必求于本。”阴阳的相反相成、对立统一的运动是物质世界发生、发展和变化的法则、纲领、根本和内在动力。因此，中医学“察色按脉，先别阴阳”，综合分析辨别疾病证候之变化；“谨察阴阳所在而调之，以平为期”，治病求本的治疗思想，以调整阴阳为基本治疗原则。“法于阴阳”为养生之道，顺应四时之变为维护健康的首要（B对）。